氯沙坦抗高血压的作用机制是
A. 抑制血管紧张素Ⅰ的生成
B. 阻断β受体
C. 减少血管紧张素Ⅱ生成
D. 抑制缓激肽降解
E. 阻断血管紧张素Ⅱ受体

正确答案：E。阻断血管紧张素Ⅱ受体